某患者右侧舌背小圆形血管瘤，边界清约1.0cm×1.0cm大小，拟行手术切除，手术时应注意
A. 采用细针细线，以减小瘢痕
B. 进针点距创缘近些，缝得浅些
C. 最好不用褥式缝合
D. 尽量保持舌的长度
E. 尽量保持舌的宽度

正确答案：D。尽量保持舌的长度

解析：舌损伤修复原则：①舌组织有缺损时缝合创口应尽量保持舌的长度，将创口按前后纵行方向缝合。不要将舌尖向后折转缝合，以防舌体缩短，影响舌功能。②如舌的侧面与邻近牙龈或舌的腹面与口底黏膜都有创面时，应分别缝合各部的创口；如不能封闭所有的创面时，应先缝合舌的创口，以免日后发生粘连，影响舌活动。③舌组织较脆，活动性大，缝合处易于撕裂，故应采用较粗的丝线（4号以上缝线）进行缝合。进针距创缘要稍远，深度要深。尽可能多带一些组织，以防创口裂开或缝线松脱，最好加用褥式。掌握“口腔颌面部软组织创伤”知识点。